服用后可致视物模糊，驾驶员应慎用的药物是
A. 氯苯那敏
B. 吲达帕胺
C. 胰酶
D. 阿司匹林
E. 阿托品

正确答案：E。阿托品

解析：本题考查驾驶员用药。服用后可致视物模糊，驾驶员应慎用的药物是阿托品（E对）。阿托品为扩瞳药，可导致视物模糊，驾驶员应慎用。氯苯那敏（A错）为抗组胺药，可引起眩晕、头痛、倦怠、嗜睡、乏力等反应。吲哒帕胺（B错）为降血压药，等可能会引起心悸、心绞痛、体位性低血压、头痛、眩晕和嗜睡等。胰酶（C错）为助消化药，孕妇及哺乳期妇女慎用。阿司匹林（D错）对于妊娠及哺乳期妇女应禁用。